健康危险因素评价的主要目的是
A. 寻找疾病的生物学病因
B. 促进人们改变不良的行为生活方式
C. 延长人类寿命
D. 改善生活条件
E. 便于疾病的早期诊断和治疗

正确答案：B。促进人们改变不良的行为生活方式